鱼腥草滴眼液中含有的羟苯乙酯是用作
A. 增溶剂
B. 润湿剂
C. 抑菌剂
D. 助悬剂
E. 助溶剂

正确答案：C。抑菌剂

解析：本题考查的是眼用制剂的附加剂。鱼腥草滴眼液中含有的羟苯乙酯是用作抑菌剂（C对）。眼用制剂的附加剂有：（1）渗透压调节剂：除另有规定外，水溶性滴眼剂、洗眼剂和眼用注射溶液应与泪液等渗。洗眼剂属于用量较大的眼用制剂，也应尽可能与泪液等渗。常用渗透压调节剂有氯化钠、硼酸、葡萄糖、硼砂等。（2）pH调节剂：洗眼剂应与泪液有相近的pH，常用的pH调节剂有磷酸盐缓冲液、硼酸盐缓冲液等。（3）抑菌剂：多剂量眼用制剂，应加适当抑菌剂。常用的抑菌剂有三氯叔丁醇、硝酸苯汞、苯乙醇、羟苯乙酯等。（4）黏度调节剂：适当增加滴眼剂的黏度，可减少刺激性，延缓混悬型眼用制剂沉降、延长药液在眼内滞留时间，增强药效。常用的黏度调节剂有甲基纤维素、聚乙烯醇、聚维酮等。（5）其他附加剂：根据药物性质和制备要求，还可加入增溶剂（A错）、助溶剂（E错）、抗氧剂等。润湿剂（B错）与助悬剂（D错）为混悬液的添加剂。润湿剂：系指疏水性药物制备混悬剂时，常加入以利于分散的附加剂。常用的润湿剂有吐温类、司盘类表面活性剂等。助悬剂：能增加分散介质的黏度、降低微粒的沉降速度，同时能被药物微粒表面吸附形成机械性或电性保护膜，防止微粒间互相聚集或产生晶型转变，或使混悬液具有触变性，从而增加其稳定性的附加剂。